挥发油的主要成分
A. 二萜类
B. 三萜类
C. 单萜类
D. 小分子脂肪族类化合物
E. 倍半萜类

正确答案：C、D、E。单萜类；小分子脂肪族类化合物；倍半萜类

解析：本题考查挥发油的化学组成。挥发油的主要成分单萜类（C对）、小分子脂肪族类化合物（D对）、倍半萜类（E对）。挥发油大多数是由几十种至几百种化合物组成的复杂混合物。挥发油虽组成成分复杂，但多以数种化合物占较大比例，为主成分，从而使不同的挥发油具有相对固定的理化性质及生物活性。挥发油的组成成分主要有四类：萜类化合物、芳香族化合物、脂肪族化合物、其他类化合物。萜类化合物：萜类在挥发油的组成成分中所占比例最大，主要是单萜、倍半萜及其含氧衍生物，其含氧衍生物多是该油中生物活性较强或具芳香气味的主要成分。二萜（A错）是指骨架由4个异戊二烯单位构成，含20个碳原子的一类萜类衍生物。多数三萜类（B错）化合物是一类基本母核由30个碳原子组成的萜类化合物，其结构根据异戊二烯定则可视为六个异戊二烯单位聚合而成，也是一类重要的中药化学成分。